有关报告事项的调查核实说法不正确的是
A. 立即组织力量对报告事项调查
B. 采取必要的控制措施
C. 及时报告调查情况
D. 不得隐瞒、缓报
E. 可授意他人隐瞒

正确答案：E。可授意他人隐瞒

解析：报告事项的调查核实：接到报告的地方人民政府、卫生行政主管部门在依照规定报告的同时，应当立即组织力量对报告事项调查、核实、确证，采取必要的控制措施，并及时报告调查情况。任何单位和个人对突发事件，不得隐瞒、缓报、谎报或者授意他人隐瞒、缓报、谎报。掌握“突发公共卫生事件报告与法律责任”知识点。